一患者因车祸伤及颅面部，有一过性昏迷病史，急诊检查发现颧部凹陷，眶周瘀血，咬合正常，张口受限，可能的原因是
A. 患者出现休克症状
B. 骨折块发生内陷移位，压迫了颞肌和咬肌
C. 患者臆症
D. 下颌骨移位
E. 神经损伤

正确答案：B。骨折块发生内陷移位，压迫了颞肌和咬肌

解析：本题考查颧骨及颧弓骨折。颧面部塌陷畸形、眶周淤血、张口受限为颧骨颧弓骨折表现，由于骨折块发生内陷移位（B对），压迫了颞肌和咬肌，阻碍了冠突运动，导致张口疼痛和开口受限。与患者出现休克症状（A错）、患者臆症（C错）无关。颧骨颧弓骨折一般不导致下颌骨移位（D错）。颧骨颧弓骨折可损伤眶下神经，导致其支配区域出现麻木感，或损伤面神经颧支，出现眼睑闭合不全（E错）。